关于体内酶促反应特点的叙述，错误的是
A. 只能催化热力学上允许进行的反应
B. 具有可调节性
C. 温度对酶促反应速度没有影响
D. 具有高催化效率
E. 可大幅降低反应活化能

正确答案：C。温度对酶促反应速度没有影响